急性菌痢主要的病变部位为
A. 小肠
B. 直肠和乙状结肠
C. 横结肠
D. 升结肠
E. 回盲部

正确答案：B。直肠和乙状结肠